一般黏固固定修复体前常用的消毒剂是
A. 75%乙醇
B. 甲醛甲酚
C. 木榴油
D. 樟脑酚
E. 碘伏

正确答案：A。75%乙醇

解析：修复体的一般处理：修复体在试合满意后，应仔细清洗，去除油污、残留的抛光剂及切割碎屑。用75%乙醇消毒、吹干。掌握“修复体试戴、磨光与粘固”知识点。